关于外侧丘系纤维的描述，正确的是
A. 发自下橄榄核
B. 全止于上丘
C. 止于红核
D. 传送头颈都本体感觉冲动
E. 含有两侧来的听觉纤维

正确答案：E。含有两侧来的听觉纤维

解析：外侧丘系主要参与听觉的传导。其发自上橄榄核外侧（A错），经中脑被盖的背外侧部大多数止于下丘核（BC错）。外侧丘系参与听觉传导通路（D错），含有两侧来的听觉纤维（E对）。